在水体污染源的调查内容中，有一条与大气的污染源相似，即
A. 企业的种类、性质和规模
B. 产生废水的工艺流程，所含毒物种类和浓度
C. 用水量、排水量
D. 废水排放口位置
E. 废水净化处理情况

正确答案：A。企业的种类、性质和规模

解析：本题考查水体污染源的调查内容。企业的种类、性质和规模（A对BCDE错）是水体污染源调查的重要内容，有助于调查人员了解企业是否存在污染源，以及企业的经营规模，这样可以更好地了解企业的污染源是否严重，以及是否可能造成环境污染。